评价的实质是
A. 监督
B. 比较
C. 监测
D. 质控
E. 总结

正确答案：B。比较